男性，52岁。车祸致骨盆骨折，脾破裂，脾切除术后胃瘫，给予静脉输入25％葡萄糖400ml和其它液体，术后10天患者出现皮肤、巩膜黄染，并进行性加重，化验血糖20.3mmol/L。出现黄疸的最可能的原因是
A. 复合伤导致肝功能失代偿
B. 糖代谢紊乱导致肝功能损害
C. 电解质紊乱导致肝功能损害
D. 药物中毒导致肝功能损害
E. 输血所致血管内溶血

正确答案：B。糖代谢紊乱导致肝功能损害

解析：患者术后胃瘫，静脉输注25％葡萄糖400ml后出现黄疸，化验血糖20.3mmol/L。出现黄疸的最可能原因应为糖代谢紊乱导致肝功能损伤（B对）。摄入体内的葡萄糖除功能外，大部分转化为甘油三酯储存在脂肪组织，还有一小部分经小肠黏膜吸收后，由门静脉到达肝脏，在肝内转变为肝糖原。摄入的过量的糖导致糖代谢紊乱，肝细胞合成甘油三酯增多，而把甘油三酯运出肝脏的极低密度脂蛋白被消耗殆尽，最终造成脂质的合成和分泌失衡。脂质异常沉积的肝细胞发生氧化应激和脂质过氧化，导致线粒体功能障碍、炎症介质的产生，肝星状细胞激活，从而发生脂肪性肝炎。复合伤导致肝功能失代偿多表现为肝脏酶水平增高，一般不出现黄疸（A错）。患者未输血（E错），亦无明显电解质紊乱（C错）、药物中毒症状（D错）。